固体药物以1～100nm微细粒子分散在水中形成的非均匀液体分散体系
A. 糖浆剂
B. 溶胶剂
C. 芳香水剂
D. 高分子溶液剂
E. 溶液剂

正确答案：B。溶胶剂

解析：本题考查溶胶剂。溶胶剂（B对）系指固体药物以多分子聚集体形式分散在水中形成的非均相液体制剂，也称为疏水胶体，药物微粒在1～100nm之间；糖浆剂（A错）系指含有药物的浓蔗糖水溶液；芳香水剂（C错）为挥发油或其他挥发性芳香药物的饱和或近饱和澄明水溶液；高分子溶液剂（D错）指高分子化合物溶解于溶剂中制成的均匀分散的液体制剂；溶液剂（E错）系指药物溶解于溶剂中形成的澄明液体制剂。